痰火扰神证与痰蒙心神证的共有症状
A. 谵语
B. 吐衄
C. 痴呆
D. 神昏
E. 狂躁

正确答案：D。神昏

解析：“痰火扰神证，临床表现为发热，口渴，胸闷，气粗，咯吐黄痰，喉间痰鸣，心烦，失眠，甚则神昏谵语，或狂躁妄动，打人毁物，不避亲疏，胡言乱语，哭笑无常，面赤，舌质红，苔黄腻，脉滑数，，以神志狂躁、神昏谵语与痰热症状共见为主；痰蒙心神证，临床表现为神情痴呆，意识模糊，甚则昏不知人，或情志抑郁，表情淡漠，喃喃独语，举止失常。或突然昏仆，不省人事，口吐涎沫，喉有痰声。并见面色晦暗，胸闷，呕恶，舌苔白腻，脉滑等症。二者均有神志异常的表现，均可见神昏（D对）。谵语仅见于痰火扰神证，不见于痰蒙神窍证（A错）。吐衄均不见于痰火扰神证与痰蒙心神证(B错)。痴呆仅见于痰蒙神窍证，不见于痰火扰神证（C错）。狂躁仅见于痰火扰神证，不见于痰蒙神窍证（E错）。